男，60岁。上腹胀，隐痛伴皮肤黄染食欲不振、厌油腻饮食1个月，症状进行性加重，体重共减轻5kg。10天前开始大便颜色逐渐变浅，近2天大便呈白陶土样。查体：巩膜明显黄染，肝肋下未触及，右肋缘下可触及肿大的胆囊底部，无触痛。实验室检查：血总胆红素340umol/L，血AFP5μg/L。最可能的诊断是
A. 胆囊结石
B. 肝门部胆管癌
C. 肝癌
D. 胆总管下段癌
E. 胆总管结石

正确答案：D。胆总管下段癌

解析：老年患者，上腹胀，隐痛伴皮肤黄染食欲不振、厌油腻饮食，症状进行性加重，体重减轻，近期大便颜色逐渐变浅，近2天大便呈白陶土样（胆管癌的典型临床表现），查体：巩膜明显黄染，肝肋下未触及，右肋缘下可触及肿大的胆囊底部（提示肿瘤位于胆管下段），无触痛，实验室检查：血总胆红素340umol/L（正常值为1.7-17.1µmol/L，提示胆红素升高），血AFP5μg/L（正常值<25µg/L），根据该患者的临床最可能的诊断是胆总管下端癌（D对），胆管癌是指发生在肝外胆管，即左、右肝管至胆总管下端的恶性肿瘤，主要表现为黄疸、胆囊肿大、胆道感染。病变在中、下段的可触及肿大的胆囊，而上段胆管癌胆囊不肿大，甚至缩小（B错）。胆囊结石（A错）及胆总管结石（E错）的典型症状为胆绞痛，只有少数病人出现，且一般不伴有黄疸及胆红素升高。肝癌（C错）患者多有肝炎病史且AFP明显升高。